垃圾的主要用途是
A. 做肥料
B. 回收利用
C. 发电
D. 制沼气
E. 以上都不是

正确答案：A。做肥料

解析：本题考查垃圾的主要用途。垃圾的分类处理有很多种方式，其中最常见的就是做肥料（A对BCDE错）。做肥料是将垃圾进行分类处理的一种方式，它可以将垃圾中的有机物质分解，转化为有益的肥料，从而改善土壤质量，提高作物的产量。做肥料的过程中，可以将垃圾中的有害物质进行分离，从而减少对环境的污染。